男，45岁，饱餐后出现上腹痛7小时，伴呕吐，疼痛持续性，向腰背部放射，蜷缩体位稍减轻，血清淀粉酶650U/dl。最可能的诊断是
A. 急性胆囊炎
B. 心肌梗死
C. 急性胰腺炎
D. 肾结石
E. 急性胃炎

正确答案：C。急性胰腺炎

解析：男，45岁，饱餐后出现上腹痛7小时（过度进食是急性胰腺炎的常见诱因），伴呕吐，疼痛持续性，向腰背部放射，蜷缩体位稍减轻（急性腹痛是急性胰腺炎患者常见首发症状），血清淀粉酶650U/dl（正常35~135U/L）。最可能的诊断是急性胰腺炎。